下列关于急性乳腺炎郁乳期治疗的叙述，错误的是
A. 可行乳房按摩
B. 及早切开引流
C. 青霉素皮试后作肌内注射
D. 太乙膏合红灵丹外贴患部
E. 取金黄散调成糊状外敷患部

正确答案：B。及早切开引流

解析：急性乳腺炎，是乳腺的急性化脓性炎症，最常见于哺乳期妇女，尤见于初产妇。急性乳腺炎郁乳期，即急性炎症期，可进行的治疗有乳房按摩（A对），青霉素皮试后作肌内注射（C对），太乙膏合红灵丹外贴患部（D对），取金黄散调成糊状外敷患部（E对）。此期患者尚未化脓，不宜切开（B错，为本题正确答案）